WHO提出卫生系统的主要目标是
A. 改善公众的健康状况
B. 对公众的期望做出反应
C. 为防止公众疾病经济负担提供资金保护
D. A＋C
E. A＋B＋C

正确答案：E。A＋B＋C

解析：本题考查卫生系统的主要目标。卫生系统的3个主要目标是：①改善公众的健康状况；②对公众的期望做出反应；③为防止公众疾病经济负担提供资金保护。本题中的三点都对（E对ABCD错）。